有毛细血管分布的结构是
A. 角膜
B. 软骨
C. 表皮
D. 毛发
E. 真皮

正确答案：E。真皮

解析：角膜（A错）、软骨（B错）、表皮（C错）、毛发（D错）均无毛细血管分布。真皮（E对）为有毛细血管分布的结构。